温度刺激出现迟缓且不严重的疼痛，表明可能是
A. 牙髓正常
B. 牙髓坏死
C. 可复性牙髓炎
D. 急性牙髓炎
E. 慢性牙髓炎

正确答案：E。慢性牙髓炎

解析：迟钝：同样程度的冷、热刺激可引起比对照牙轻微许多的反应。被测牙齿较正常对照牙的感觉反应轻微且慢，表示患牙可能有慢性炎症、牙髓变性或牙髓部分坏死。“迟缓性痛”：即刺激去除后一会患牙才出现疼痛反应，并持续一段时间，表示患牙可能为慢性牙髓炎或牙髓大部分坏死。掌握“可复性、急慢性牙髓炎”知识点。